关于判断生物地球化学性疾病，不正确的是
A. 疾病发生有明显的地区性
B. 与该地区某种化学元素之间关系密切
C. 疾病的发生与地质中某种化学元素之间有明显的剂量-反应关系
D. 受害人群广泛性及是否爆发流行
E. 疾病的发生在不同时间、地点、人群中有同样的相关性

正确答案：D。受害人群广泛性及是否爆发流行

解析：本题考查生物地球化学性疾病的判断。生物地球化学性疾病是由于地壳表面化学元素分布的不均匀性，使某些地区的水和（或）土壤中某些元素过多或过少，当地居民通过饮水、食物等途径摄入这些元素过多或过少，而引起某些特异性疾病。生物地球化学性疾病的判定需要用流行病学方法对人群中某种健康危害的发生率与某种化学元素之间的关系进行研究，要符合下列条件才能作出比较肯定的结论：①疾病的发生有明显的地区性（A对）；②疾病的发生与地质中某种化学元素之间有明显的剂量反应关系（BC对）。此外，疾病的发生在不同时间、地点、人群中有同样的相关性（E对）。生物地球化学性疾病的判断与受害人群广泛性及是否爆发流行（D错，为本题正确答案）无关。